目前对乙型肝炎最主要的防治手段是
A. 注射免疫球蛋白，保护高危人群
B. 接种乙肝疫苗，保护易感人群
C. 加强HBsAg携带者的管理
D. 切断传播途径
E. 阻断母婴传播

正确答案：B。接种乙肝疫苗，保护易感人群